有关表面活性剂的叙述，正确的有
A. 表面活性剂的亲水亲油平衡值又称为HLB值
B. 表面活性剂的亲水亲油平衡值越高，其亲水性越强
C. 表面活性剂的临界胶团浓度与其结构和组成有关
D. 起昙是表面活性剂的通性
E. 因非离子型表面活性剂毒性较小，故广泛应用于静脉给药制剂

正确答案：A、B、C、E。表面活性剂的亲水亲油平衡值又称为HLB值；表面活性剂的亲水亲油平衡值越高，其亲水性越强；表面活性剂的临界胶团浓度与其结构和组成有关；因非离子型表面活性剂毒性较小，故广泛应用于静脉给药制剂